某片剂主药含量应为0.33g，如果测得颗粒中主药含量为66%，那么片重为
A. 0.1g
B. 0.2g
C. 0.3g
D. 0.4g
E. 0.5g

正确答案：E。0.5g

解析：本题考查片重的计算。主药含量计算片重的公式为：片重＝每片含主药量/干颗粒中主药的百分含量，则此片剂的片重＝0.33g/66％＝0.5g（E对）。